《中国药典》中检查阿司匹林中游离水杨酸限量方法是
A. 酸碱滴定法
B. 亚硝酸钠滴定法
C. 碘量法
D. 高效液相色谱法
E. 气相色谱法

正确答案：D。高效液相色谱法

解析：本题考查含量测定。《中国药典》中检查阿司匹林中游离水杨酸限量方法是高效液相色谱法（D对）。《中国药典》中采用1%冰醋酸甲醇溶液制备供试品溶液，以防阿司匹林水解，同时采用高效液相色谱法（HPLC）检查游离水杨酸。酸碱滴定法（A错）是以质子转移反应为基础的滴定分析方法，一般的酸、碱以及能与酸碱直接或间接发生质子转移的物质，几乎都可以用酸碱滴定法测定，由于阿司匹林中的游离水杨酸的含量小，用酸碱滴定法灵敏度小，误差较大，故不用酸碱滴定法测定。亚硝酸钠滴定法（B错）是用亚硝酸钠滴定液在盐酸溶液中与芳伯氨基定量发生重氮化反应，生成重氮盐以测定含芳伯氨基或含潜在芳伯氨基药物的含量。碘量法（C错）是以碘作为氧化剂，或以碘化钾作为还原剂进行氧化还原滴定的方法，用于测定具有还原性的药物。气相色谱法（E错）用气体作为流动相载气，常用于性质不稳定，沸点低易气化物质的分离测定。